Addison病患者可出现
A. 低钾血症
B. 低镁血症
C. 两者均有
D. 两者均无
E. 无

正确答案：D。两者均无

解析：Addison病又称原发性慢性肾上腺皮质功能减退症，醛固酮分泌减少，肾保钠保水排钾排镁作用减弱可致高镁血症和高钾血症（AB错，故D为本题正确答案）。